男性，45岁。肝炎病史20余年，近2月来出现右侧季肋部持续胀痛，伴厌食、乏力和腹胀。查体：右侧肋缘下可触及到肿大的肝脏，质地坚硬，边缘不规则；AFP＞1000μg/L。有确定诊断意义的检查是
A. 肝功能检查
B. CT
C. MRI
D. 肝穿刺针吸细胞学检查
E. 选择性肝动脉造影

正确答案：D。肝穿刺针吸细胞学检查

解析：患者肝炎病史20年，近期出现肝大、肝区疼痛、全身及消化道症状和AFP＞1000μg/L，应怀疑原发性肝癌，超声引导下肝穿刺针吸细胞学检查（D对）可以发现癌细胞，是诊断肝癌的金标准，最具有确诊意义。肝功能检查（A错）仅可反应肝脏的功能状态，并不具有诊断肝癌的特异性，故其不是对肝癌具有诊断意义的检查。CT（B错）与MRI（C错）有助于发现肝部占位及占位对周围组织的浸润情况，但无法确定肿物性质，故其不是对肝癌具有诊断意义的检查。选择性肝动脉造影（E错）有助于鉴别肝血管瘤与肝癌，但无法确定肿物性质，故其不是对肝癌具有诊断意义的检查。